有机氯农药的主要缺点是
A. 高残留性
B. 低效性
C. 高抗药性
D. 急性毒性
E. 高毒性

正确答案：A。高残留性

解析：本题考查有机氯农药的主要缺点。有机氯农药是组成成分中含有氯元素的有机化合物，是最早使用的化学合成农药。该类农药具有高度的物理、化学、生物学稳定性，属于高残留农药（A对BCDE错）。